患儿，女，6岁。两个月来小便频数，淋沥不尽，精神倦怠，面色苍黄，手足不温，大便稀薄，眼睑微肿，舌淡苔薄，脉细无力。治疗应首选
A. 八正散
B. 缩泉丸
C. 导赤散
D. 菟丝子散
E. 龙胆泻肝汤

正确答案：B。缩泉丸

解析：患儿小便频数，淋漓不尽，当属尿频，肾主闭藏而司二便，肾气虚则下元不固，气化不利，开阖失司，脾主运化而制水，脾气虚则中气下陷、精神倦怠、面色苍黄，运化失常，水失制约，则见大便稀薄、眼睑微肿，舌脉亦为脾肾气虚之象，治以缩泉丸，可温补脾肾，升提固摄（B对）。八正散适于湿热下注的尿频，症见尿频、尿急、尿痛，小便短赤，或见发热，烦渴，恶心呕吐，舌红苔腻（A错）。导赤散适于心经火热证，症见口舌生疮，小便赤涩刺痛，舌红，脉数（C错）。菟丝子散适于肾气不足的遗尿，症见遗尿日久，次数较多，兼见虚寒诸症（D错）。龙胆泻肝汤适于肝经湿热的遗尿，症见尿少色黄，齘齿，性情急躁，目睛红赤（E错）。